生马钱子需
A. 零售企业凭盖有医疗单位公章的医生处方限量供应
B. 实行专库（柜）、双人、双锁保管
C. 两者均需
D. 两者均不需

正确答案：C。两者均需

解析：本题考查毒性药品。生马钱子需零售企业凭盖有医疗单位公章的医生处方限量供应，实行专库（柜）、双人、双锁保管（C对）。生马钱子属于毒性药品中的中药品种。储存毒性药品的专库或专柜，其条件要求与储存麻醉药品的专库条件相同，毒性药品可与麻醉药品存放在同一专用库房或专柜中。专库或专柜加锁并由专人保管，做到双人双锁管理，专账记录。医疗机构供应和调配毒性药品，须凭执业医师签名的正式处方。调配处方时，必须认真负责，计量准确，按医嘱注明要求，并由配方人员及具有药师以上技术职称的复核人员签名盖章后方可发出。对处方未注明“生用”的毒性中药，应当付炮制品。如发现处方有疑问时，须经原处方医生重新审定后再行调配。处方一次有效，取药后处方保存2年备查。